某女，39岁。经行小腹冷痛，得热则舒，月经量少，色紫暗有块，形寒肢冷，小便清长。诊断为痛经，证属寒凝血瘀。治宜选用的中成药有
A. 温经丸
B. 少腹逐瘀丸
C. 潮安胶囊
D. 妇女养血丸
E. 八宝坤顺丸

正确答案：A、B。温经丸；少腹逐瘀丸

解析：本题考查痛经之寒凝血淤证的常用中成药。结合症状患者为寒凝血淤证，宜选用温经丸（A对）、少腹逐瘀丸（B对）。痛经之寒凝血瘀证【症状】经行小腹冷痛，得热则舒，经量少，色紫暗有块；形寒肢冷，小便清长。脉细或沉紧。【中成药应用】温经丸、少腹逐瘀丸、妇科万应膏。痛经之湿热瘀阻证【症状】经前或经期小腹灼热胀痛，拒按，经色暗红，质稠有块；平素带下量多色黄，或平时小腹疼痛，经来疼痛加剧，或伴经前低热，小便黄赤。舌质红，苔黄而腻，脉滑数或涩。【中成药应用】当归芍药颗粒、潮安胶囊（C错）。痛经之气血虚弱证【症状】经期或经后小腹隐痛喜按，或小腹空坠不适，月经量少，色淡，质清稀；面色无华，头晕心悸，神疲乏力。舌淡，脉细无力。【中成药应用】妇女养血丸（D错）、参茸白凤丸、八宝坤顺丸（E错）。